肱桡肌由以下何神经支配
A. 腋神经
B. 肌皮神经
C. 桡神经
D. 正中神经
E. 无

正确答案：C。桡神经

解析：腋神经（A错）支配三角肌和小圆肌。肌皮神经（B错）支配喙肱肌、肱二头肌和肱肌。桡神经（C对）主要分布于肱三头肌、肘肌、肱桡肌和桡侧腕长伸肌。正中神经（D错）支配除肱桡肌、尺侧腕屈肌和指深屈肌尺侧半以外的所有前臂屈肌和旋前肌。